为了减少对眼部的刺激性，需要调整滴眼剂的渗透压与泪液的渗透压相近、用作滴眼剂渗透压调节剂的辅料是
A. 羟苯乙酯
B. 聚山梨酯
C. 依地酸二钠
D. 硼砂
E. 羟甲基纤维素钠

正确答案：D。硼砂

解析：本题考查用作滴眼剂渗透压调节剂的辅料。硼砂（D对）用作滴眼剂渗透压调节剂辅料；羟苯乙酯（A错）为常用的防腐剂；聚山梨酯（B错）为常用的增溶剂；依地酸二钠（C错）是金属络合剂；羟甲基纤维素钠（E错）常作为混悬液的助悬剂。